女子胞与下列哪些脏腑的关系不密切
A. 肝
B. 心
C. 脾
D. 肺
E. 肾

正确答案：D。肺

解析：女子以血为本，经水为血液所化，月经的来潮和周期，以及孕育胎儿，均离不开气血的充盈和血液的正常运行。而心主血（B对），肝藏血（A对），脾胃为气血生化之源又主统血（C对）。肾藏精，关乎天癸，且精能化血（E对）（D错，为本题正确答案）。